不能减小前列腺的体积，也不能降低PSA水平，但可松弛前列腺平滑肌，缓解膀胱和下尿道急性症状的药物是
A. 西地那非
B. 非那雄胺
C. 坦索罗辛
D. 他达拉非
E. 度他雄胺

正确答案：C。坦索罗辛

解析：本题考查抗前列腺增生症药。不能减小前列腺的体积，也不能降低PSA水平，但可松弛前列腺平滑肌，缓解膀胱和下尿道急性症状的药物是坦索罗辛（C对）。坦索罗辛为α₁受体阻断药，不能减小前列腺增大的体积，也不降低血清前列腺特异抗原（PSA）水平，不能减少急性尿潴留的发生。适于需要尽快改善急性症状的患者。西地那非（A错）、他达拉非（D错）为5型磷酸二酯酶抑制剂。非那雄胺（B错）和度他雄胺（E错）属于5α-还原酶抑制剂。